流行性出血热治疗原则为“稳、促、导、透”的时期是
A. 发热期
B. 低血压休克期
C. 少尿期
D. 多尿期
E. 恢复期

正确答案：C。少尿期

解析：流行性出血热，即肾综合征出血热，临床以发热、出血、低血压性休克和肾脏损害为主要特征。典型病例表现为发热、低血压休克、少尿、多尿与恢复期五期经过。各期的治疗原则如下所述：（1）发热期（A错）：①一般治疗；②抗病毒治疗；③改善中毒症状和对症治疗；④预防DIC。（2）低血压休克期（B错）：①补充血容量，强调“一早”、“二快”、“三适量”；②纠正酸中毒；③强心剂的应用；④血管活性药物与糖皮质激素的应用。（3）少尿期（C对）：①稳定内环境；②促进利尿；③导泻疗法；④透析疗法。（4）多尿期（D错）：①稳定内环境②预防感染③支持疗法。（5）恢复期（E错）：注意休息，逐渐增加活动量，加强营养。